羌活的主治病证是
A. 太阳头痛
B. 阳明头痛
C. 少阳头痛
D. 厥阴头痛
E. 少阴头痛

正确答案：A。太阳头痛

解析：本题考查羌活的主治病证。羌活的主治病证是太阳头痛（A对）。羌活【主治病证】（1）风寒表证，表证夹湿，太阳头痛。（2）风寒湿痹。白芷【主治病证】（1）外感风寒或表证夹湿兼头痛鼻塞。（2）阳明头痛（B错），眉棱骨痛，鼻渊头痛，牙痛。（3）风寒湿痹，寒湿带下。（4）疮疡肿毒。独活【主治病证】（1）风寒湿痹，腰膝酸痛。（2）表证夹湿。（3）少阴头痛（E错），皮肤湿痒。